乳痈肝胃郁热证的内服方剂宜用
A. 五味消毒饮
B. 黄连解毒汤
C. 丹栀逍遥散
D. 柴胡清肝汤
E. 瓜蒌牛蒡汤

正确答案：E。瓜蒌牛蒡汤

解析：瓜蒌牛蒡汤功效清热疏肝，通乳散结，主治乳痈初起，红肿热痛，或身发寒热，为治疗乳痈肝胃郁热证代表方（E对）。五味消毒饮功效清热解毒，消散疔疮，主治火毒结聚之疔疮（A错）。黄连解毒汤功效泻火解毒，主治三焦火毒热盛证（B错）。丹栀逍遥散功效养血健脾，疏肝清热，主治肝郁血虚内热证（C错）。柴胡清肝汤功效养血清火，疏肝散结，主治血虚火动，肝气郁结，致患鬓疽，初起尚未成脓者（D错）。